男，20岁，神志不清2小时入院，既往患1型糖尿病5年，长期皮下注射胰岛素，近3天因腹泻而停用。体检：血压70/50mmHg，皮肤中度失水征，呼吸深大，有烂苹果味，心率130次/分。需立即采取的治疗措施是
A. 静脉滴注5%碳酸氢钠
B. 纠正电解质紊乱
C. 补液并恢复皮下注射胰岛素
D. 补液加有效的抗生素
E. 补液同时静脉滴注胰岛素

正确答案：E。补液同时静脉滴注胰岛素

解析：Ⅰ型糖尿病患者（易自发糖尿病酮症酸中毒），长期胰岛素治疗，近3天中断使用（诱因）后，呼吸深大（Kussmaul深大呼吸常提示酸中毒）、有烂苹果味（丙酮主要经呼吸道排出，提示血中丙酮含量增多），皮肤中度失水征、休克（BP70/50mmHg、P130次/分），神志不清2小时，最可能的诊断为糖尿病酮症酸中毒昏迷。患者失水严重，血压降低达休克状态并出现意识障碍，应立即补液、扩充血容量，恢复血压。同时静注短效胰岛素降低血糖，使机体优先利用血糖从而降低血酮。因此本例患者应立即采取的治疗措施为补液同时静脉滴注胰岛素（E对）。由于皮下注射胰岛素（C错）吸收较慢，降低血糖较慢，多用于病情稳定后常规使用胰岛素，不用于糖尿病急性并发症。酮症酸中毒经输液和胰岛素治疗后，酮体水平下降，酸中毒可自行纠正，一般不必补碱（A错），当血PH＜7.1，HCO₃⁻＜5mmol/L时再进行补碱（P754）。纠正电解质紊乱（B错）是治疗原则之一，但不是立即采取的治疗措施。当患者存在感染时，才加用抗生素，该患者无明显感染表现，故目前不需使用抗生素（D错）。